需做再植术的是
A. 年轻恒牙冠折牙本质暴露
B. 年轻恒牙根折
C. 全脱位半小时的恒牙
D. 乳牙嵌入
E. 乳牙牙齿震荡

正确答案：C。全脱位半小时的恒牙

解析：全脱出：常见于单个年轻恒牙，上颌中切牙多发。牙齿全脱位时应该立即进行再植术。本题考查年轻恒牙外伤。